在我国20世纪20年代，猩红热重型病例多见，病死率可高达15%～20%，但近年来其发病率与死亡率均有明显降低，几乎未见有病死者。这是疾病在时间分布上表现出的
A. 短期波动
B. 季节性
C. 周期性
D. 长期趋势
E. 散发

正确答案：D。长期趋势